睾丸鞘膜
A. 由腹壁肌向外突出形成
B. 由腹横筋膜向外突出形成
C. 由腹膜鞘突近侧部形成
D. 由腹膜鞘突远侧部形成
E. 由腹外斜肌腱膜形成

正确答案：D。由腹膜鞘突远侧部形成

解析：由腹膜鞘突远侧部形成（D对）为睾丸鞘膜。